以下有关肠道杆菌的叙述中正确的是
A. 多数有菌毛、周鞭毛，少数有荚膜
B. 非致病菌大多分解乳糖
C. 所有肠道杆菌都不形成芽胞
D. 革兰氏染色为阴性
E. 以上均正确

正确答案：E。以上均正确

解析：肠道杆菌呈中等大小的杆状，直径0.3～1.0μm，长2～3μm，革兰氏染色为阴性，多数有菌毛、周鞭毛，少数有荚膜，不形成芽胞。致病菌一般不分解乳糖，而非致病菌大多分解乳糖。掌握“志贺氏及沙门氏菌属”知识点。